用俞募配穴法治疗胃病，应选下列哪组穴位
A. 脾俞、胃俞
B. 胃俞、太白
C. 胃俞、足三里
D. 脾俞、中脘
E. 胃俞、中脘

正确答案：E。胃俞、中脘

解析：俞募配穴法是前后配穴法的典型实例，是把脏腑的俞穴和募穴配合运用，发挥其协同做到的配穴法。脾俞、胃俞均为俞穴（A错）。胃俞为胃的俞穴，太白为脾的原穴（B错）。胃俞为胃的俞穴，足三里为胃的合穴（C错）。脾俞为脾的俞穴，中脘为胃的募穴（D错）。胃俞为胃的俞穴，中脘为胃的募穴，两者相配属俞募配穴法（E对）。